治疗风湿痹痛，筋脉拘挛应首选
A. 威灵仙
B. 千年健
C. 木瓜
D. 独活
E. 白花蛇舌草

正确答案：C。木瓜

解析：木瓜善于舒筋活络，且能祛湿除痹，为治湿痹筋脉拘挛之要药（C对）。威灵仙（A错）辛散温通，性猛善走，既能祛风湿，又能通经络而止痛，为治风湿痹痛要药。千年健（B错）用于治风寒湿痹，腰膝冷痛，拘挛麻木，筋骨痿软。独活（D错）功善祛风湿，止痹痛，为治风湿痹痛主药，凡风寒湿邪所致之痹证，无论新久，均可应用。白花蛇舌草（E错）善治痈肿疮毒，咽喉肿痛，毒蛇咬伤，热淋涩痛。